牙周膜中具有自我更新和多向分化潜能的是
A. 成骨细胞
B. 牙周膜干细胞
C. 上皮剩余细胞
D. 成牙骨质细胞
E. 成纤维细胞

正确答案：B。牙周膜干细胞

解析：本题考查牙周膜干细胞的特点。牙周膜干细胞（B对）是牙周膜中具有自我更新和多向分化潜能的细胞。成纤维细胞（E错）是牙周膜中数量最多、功能最重要的细胞，具有独特且高效的合成与分解胞外基质中胶原蛋白的能力。成牙骨质细胞（D错）分布在邻近牙骨质的牙周膜中，细胞扁平，胞核圆或卵圆形，平铺在根面上，在牙骨质形成时近似立方状。上皮剩余（C错）是牙根发育期上皮根鞘残留下的上皮细胞，为牙周膜中邻近牙骨质的纤维间隙中小的上皮条索或上皮团，与牙根表面平行排列，也称Malassez上皮剩余。成骨细胞（A错）在骨形成时，于邻近牙槽骨表面大量存在，呈立方状，胞核大，核仁明显，胞质嗜碱性，静止期的成骨细胞为梭形。